小儿指纹分三关，从虎口到食指端依次为
A. 命关、气关、风关
B. 气关、命关、风关
C. 气关、风关、命关
D. 风关、气关、命关
E. 风关、命关、气关

正确答案：D。风关、气关、命关

解析：观察指纹是儿科的特殊诊法，适用于3岁以下小儿，指纹从虎口沿食指内侧（桡侧）所显现的脉络（浅表静脉），以食指三指节横纹分风、气、命三关，食指根的第一指节为风关，第二指节为气关，第三指节为命关，故小儿指紋从虎口到食指端依次为风关、气关、命关（D对）。